衣原体的繁殖形式是
A. 内基小体
B. 中介体
C. 二十面体
D. 网状体
E. 原体

正确答案：D。网状体

解析：（P182）“原体具有感染性，在宿主细胞外较为稳定，但无繁殖能力。”（E错）